治疗风湿痹痛，水肿腹水，脚气浮肿，应选用的药物是
A. 桑寄生
B. 白花蛇
C. 防己
D. 威灵仙
E. 车前子

正确答案：C。防己

解析：防己辛能行散，苦寒降泄，既能祛风除湿止痛，又能清热，对风湿痹证湿热偏盛者尤为适宜；本品苦寒降泄，能清热利水，善走下行而泄下焦膀胱湿热，尤宜于下肢水肿，脚气浮肿，小便不利者（C对）。桑寄生（A错）应用于风湿痹痛，腰膝酸软，筋骨无力，崩漏，胎动不安，头晕目眩。白花蛇（B错）应用于风湿顽痹，麻木拘挛，中风，半身不遂，小儿惊风，麻风。威灵仙（D错）应用于风湿痹痛，骨鲠咽喉。车前子（E错）应用于热淋涩痛，水肿胀满，暑湿泄泻，目赤肿痛，痰热咳嗽。